对磺胺类药物过敏者可以选用的利尿剂是
A. 依他尼酸
B. 依托塞米
C. 布美他尼
D. 乙酰唑胺
E. 氢氯噻嗪

正确答案：A。依他尼酸

解析：本题考查药物的作用特点。对磺胺类药物过敏者可以选用的利尿剂是依他尼酸（A对）。依他尼酸是一个非磺酰胺衍生物的袢利尿剂，与其他袢利尿剂比较耳毒性更大，因此临床使用受到限制，主要用作对磺酰胺类药物过敏或不耐受患者的替代药物。依托塞米（B错）、布美他尼（C错）的化学结构中均含磺酰胺，禁用于对磺胺类药物过敏者。乙酰唑胺（D错）的化学结构中有磺胺基，是其活性必需基团，禁用于对磺胺类药物过敏者。氢氯噻嗪（E错）为磺胺类药物，与磺胺类有交叉过敏反应。